对维生素C注射液错误的表述是
A. 可采用亚硫酸氢钠作抗氧剂
B. 处方中加入碳酸氢钠调节pH值使成偏碱性，避免肌注时疼痛
C. 可采用依地酸二钠络合金属离子，增加维生素C稳定性
D. 配制时使用的注射用水需用二氧化碳饱和
E. 采用100℃流通蒸汽15min灭菌

正确答案：B。处方中加入碳酸氢钠调节pH值使成偏碱性，避免肌注时疼痛

解析：本题考查注射剂常用附加剂。维生素C是主药，显强酸性，由于注射时刺激性大，会产生疼痛，故加碳酸氢钠或碳酸钠，中和部分维生素C成钠盐（B错，为本题正确答案），以避免疼痛。同时由于碳酸氢钠的加入调节了pH，增强本品的稳定性。维生素C容易被氧化，依地酸二钠是金属螯合剂（C对），用来络合金属离子，防止药品被氧化。亚硫酸氢钠是还原剂（抗氧剂）（A对），可以防止药品被氧化。制备：在配制容器中加处方量80%的注射用水，通二氧化碳饱和，加维生素C溶解后，分次缓缓加入碳酸氢钠，搅拌使完全溶解，加入预先配制好的依地酸二钠溶液和亚硫酸氢钠溶液，搅拌均匀，调节药液pH6.0～6.2，添加二氧化碳饱和的注射用水（D对）至足量。用垂熔玻璃漏斗与膜滤器过滤，溶液中通二氧化碳，并在二氧化碳或氮气流下灌封，用100℃流通蒸汽灭菌15分钟（E对）。